与“血虚”关系最大的两脏是
A. 心与肺
B. 心与肾
C. 心与肝
D. 心与脾
E. 脾与肝

正确答案：C。心与肝

解析：本题考查的是心与肝的关系。与“血虚”关系最大的两脏是心与肝（C对）。心与肝的关系主要表现在血液与神志方面的依存与协同。1.血液运行：血液贮藏于肝，通过心气推动作用而运行于全身。心行血功能正常，肝有所藏。若肝不藏血，则心无所主，血液的运行必致失常。故“心肝血虚”常同时出现。2.神志活动：心主神明，肝主疏泄。人的意识、思维、情志等精神活动，虽由心所主，但与肝的疏泄功能亦密切相关，故心、肝病变亦都可表现为神志活动的异常。心与肺（A错）的关系，主要表现在心主血与肺主气、心主行血与肺主呼吸之间的关系。肺主气，具有助心行血之作用。肺气正常则是血液正常循行的必要条件。心主血，推动血液循行，方能维持肺呼吸功能的正常进行，故有“呼出心与肺”之说。联结心之搏动和肺之呼吸两者之间的中心环节是积于胸中的“宗气”。由于宗气具有贯心脉而行气血，走息道而司呼吸的生理功能，从而加强了血液循环与呼吸运动之间的相互联系，以及在病变上的相互影响。心与肾（B错）的关系，主要表现在心肾阴阳水火既济与心血肾精之间的依存关系。1.心肾相交：心在五行属火，位居于上而属阳；肾在五行属水，位居于下而属阴。在正常情况下，心火必须下降于肾，助肾阳以温肾水，使肾水不寒；肾水必须上济于心，滋心阴以濡心阳，使心火不亢，如此维持心肾阴阳水火协调平衡，称“心肾相交”，又称“水火既济”。2.精血互生：心主血，肾藏精，血化为精，精能生血，这种精血互生关系，体现了心肾之间的相关性。心与脾（D错）的关系，主要表现在血液的生成和运行两方面。1.血液生成：脾运化水谷精微，以生化血液。脾气旺盛，则血之生化功能正常，血液充盛心有所主。心主血，营气和津液化赤为血。心之阳气可以温养脾土，使脾阳不衰，保证了脾生化血液之正常。2.血液运行：心气推动血液循环，脾气统摄血液行于脉中，推动力和固摄力的协调平衡，从而维持血液正常循行。脾与肝（E错）的关系，主要表现在饮食物的消化和血液生成、贮藏及运行方面。1.饮食物的消化：脾的运化有赖于肝的疏泄调节。肝疏泄功能正常，则脾的运化功能健旺，饮食方能正常消化。脾气健运，水谷之精微化源充盛，方能滋养肝体，肝木得养，疏泄功能方能正常发挥。2.血液的生成、贮藏和运行：肝主疏泄而维持血行，藏血而调节血量、防止出血；脾生血、统血，又为气血生化之源。